血管紧张素转化酶抑制药是
A. 卡托普利
B. 普萘洛尔
C. 哌唑嗪
D. 氯沙坦
E. 硝苯地平

正确答案：A。卡托普利

解析：本题考查血管紧张素转化酶抑制药。卡托普利（A对）为非肽类血管紧张素转化酶抑制剂，主要作用于肾素-血管紧张素-醛固酮系统（RAAS），临床用于高血压、心力衰竭。普萘洛尔（B错）是β肾上腺素受体拮抗药，临床用于高血压、心绞痛、室上性快速心律失常、室性心律失常的等。哌唑嗪（C错）为选择性突触后α₁受体阻滞药，通过阻滞血管平滑肌突触后膜α₁受体，降低外周血管阻力，降低血压。氯沙坦（D错）是血管紧张素Ⅱ受体拮抗剂，抑制血管紧张素Ⅱ与AT₁结合，减少醛固酮分泌，减少水钠潴留，降低血压。硝苯地平（E错）为钙通道阻滞剂，临床用于高血压、冠心病、心绞痛。